男孩，12岁。肾病综合征初次治疗，口服泼尼松片2mg/Kg/d，2周后尿蛋白转阴，巩固治疗2周开始减量，改成隔日晨顿服2mg/Kg，共4周，以后每4～6周减量0.5mg/Kg，直至停药。此激素治疗方案为
A. 中程疗法
B. 冲击疗法
C. 替代疗法
D. 长程疗法
E. 短程疗法

正确答案：A。中程疗法

解析：该肾病综合征患者巩固治疗2周开始减量，改成隔日晨顿服2mg/Kg，共4周，以后每4－6周减量0.5mg/Kg，直至停药，此激素治疗方案为中程疗法（A对），约2-3个月。大剂量冲击疗法（B错）为甲泼尼龙0.5-1.0g溶于5%葡萄糖液中静脉点滴，每日或隔日1次，3次为一疗程，用于抢救危重病人。短程疗法（E错）约1个月左右，用于如结核性脑膜炎、剥脱性皮炎等疾病。长程疗法（D错）多为9-12个月，如类风湿性关节炎等，用药时间很长，停药前，必须逐渐减量，以免出现病情反跳。激素替代疗法（C错）是当患者体内缺失特定的激素时，通常采用此法进行激素替代，明显不符合本题情况。